中枢神经系统兴奋类杀鼠剂中毒最突出的临床表现是
A. 头痛、头晕
B. 恶心、呕吐
C. 腹痛、腹泻
D. 烦躁、不安
E. 抽搐、惊厥

正确答案：E。抽搐、惊厥